在肘横纹中，肱二头肌桡侧凹陷处的腧穴是
A. 尺泽
B. 曲池
C. 神门
D. 少海
E. 曲泽

正确答案：A。尺泽

解析：尺泽定位在肘区，肘横纹上，肱二头肌腱桡侧缘凹陷中（A对）。曲池定位在肘区，尺泽与肱骨外上髁连线中点凹陷处（B错）。神门定位在腕前区，腕掌侧远端横纹尺侧端，尺侧腕屈肌腱的桡侧缘（C错）。少海定位在肘前区，横平肘横纹，肱骨内上髁前缘（D错）。曲泽定位在肘前区，肘横纹上，肱二头肌腱的尺侧缘凹陷中（E错）。